下列哪项是产后用药三禁
A. 活血、通便、消导
B. 大汗、峻下、利小便
C. 清热、凉血、滋阴
D. 祛寒、开郁、化瘀
E. 以上均非

正确答案：B。大汗、峻下、利小便

解析：产后用药“三禁”，即禁大汗以防亡阳，禁峻下以防亡阴，禁通小便以防亡津液（B对E错）。产后治疗的原则，应根据亡血伤津、元气受损、瘀血内阻、多虚多瘀的特点，本着“勿拘于产后，亦勿忘于产后”的原则，结合病情进行辨证论治。常用的具体治法有补虚化瘀（D错）、清热解毒（C错）、益气固表、调理肾肝脾等。产后腹痛瘀滞子宫证治疗活血化瘀，温经止痛（A错）。产后身痛血瘀证治疗养血活血，化瘀祛湿（D错）。